关于相对危险度，下列叙述哪项不正确
A. 相对危险度的取值范围在0～∞之间
B. 相对危险度等于1，说明暴露与疾病无联系
C. 相对危险度为0.001时，比相对危险度为1.1时的联系强度更弱
D. 相对危险度小于1，说明其间存在负联系
E. 相对危险度大于1，说明其间存在正联系

正确答案：C。相对危险度为0.001时，比相对危险度为1.1时的联系强度更弱

解析：本题考查相对危险度的特点。相对危险度（RR）通常包括了危险度比或率比。危险度比是暴露组的危险度（测量指标是累积发病率）与对照组的危险度之比。率比是暴露组与对照组的发病密度之比。危险度比和率比都是反映暴露与发病（死亡）关联强度的最有用的指标。相对危险度为0.01时，其非暴露组对疾病的影响是暴露组的100倍，其联系强度要远大于相对危险度为1.1（C错，为本题正确答案）的情况。